男，13岁。剧烈运动后右膝关节前方疼痛1周。查体：右胫骨结节处有明显隆起，压痛阳性。X线片示胫骨结节骨骺增大、碎裂。最合适的处理方法是
A. 局部封闭
B. 钻孔植骨
C. 膝关节短期制动
D. 穿刺活检
E. 切除活检

正确答案：C。膝关节短期制动

解析：青少年男性患者，剧烈活动后，胫骨结节明显隆起、压痛（胫骨结节骨软骨病主要表现），X线示胫骨结节处骨骺隆起、碎裂（胫骨结节骨软骨病典型影像学表现），结合患者病史、临床表现和影像学检查，故该患者最可能的诊断为胫骨结节骨软骨病。本病在18岁前，只要减少膝关节剧烈活动症状可自行缓解；有明显疼痛者，可辅以理疗或膝关节短期制动。该患者有右膝关节前方疼痛，故最合适的处理方法是膝关节短期制动（C对）。局部封闭（A错）主要用于缓解疼痛、控制炎症。钻孔植骨（B错）、穿刺活检（D错）、切除活检（E错）均为有创操作，不适合本病的治疗。